中药二级保护品种的最低保护年限是
A. 30年
B. 7年
C. 20年
D. 10年

正确答案：B。7年

解析：本题考查中药保护品种的等级划分。中药二级保护品种的最低保护年限是7年（B对）。中药保护品种的等级划分：对受保护的中药品种分为一级和二级进行管理。中药一级保护品种的保护期限分别为30年（A错）、20年（C错）、10年（D错），中药二级保护品种的保护期限为7年。